关于RNA引物错误的是
A. 以游离NTP为原料聚合而成
B. 以DNA为模板合成
C. 在复制结束前被切除
D. 由DNA聚合酶催化生成
E. 为DNA复制提供3′-OH

正确答案：D。由DNA聚合酶催化生成